迟发型超敏性炎症发生中，下列哪种细胞因子能活化巨噬细胞
A. IFN-γ
B. TNF
C. TGF-β
D. LT
E. IL-10

正确答案：A。IFN-γ